主张对痘疹等病“温补凉泻，各附所宜”的医家是
A. 钱乙
B. 陈文中
C. 刘昉
D. 曾世荣
E. 万全

正确答案：B。陈文中

解析：南宋陈文中对小儿痘疹疾病诊治有极大帮助，首提“温补凉泻，各附所宜”（B对）。钱乙为儿科之圣，其代表作为《小儿药证直诀》，且首创儿科五脏辨证体系及从五脏论治（A错）。南宋刘昉的代表作为《幼幼新书》，是当时世界最完备的儿科学专著（C错）。元代曾世荣其代表作为《活幼心书》，是中医新生儿学较早的集中论述，以调元散、补肾地黄丸治疗胎怯（D错）。明代万全首先提出“三有余，四不足”的小儿生理病理学说，在治疗方面首重保护胃气，其著作颇丰（E错）。